在直线回归分析中，如果算得回归系数b＞0，可以认为β
A. 大于0
B. 小于0
C. 等于0
D. 不等于0
E. 还需进一步检验确定

正确答案：E。还需进一步检验确定